患者，女，27岁，孕8周，身高168cm，体重58kg，因体检尿常规结果异常就诊，白细胞300/μl。今日尿培养回报：尿细菌计数2.13×10⁵cfu/ml，患者自述无尿频、尿急、尿痛，无肉眼可见血尿，无腰痛、寒战或发热。根据以上病情描述，该患者最有可能患有的疾病是
A. 急性膀胱炎
B. 急性肾盂肾炎
C. 无症状菌尿
D. 急性复杂性尿路感染
E. 慢性肾盂肾炎

正确答案：C。无症状菌尿

解析：本题考查无症状菌尿。该患者最有可能患有的疾病是无症状菌尿（C对）。无症状菌尿是指患者无尿路感染症状，但中段尿培养连续2次（同一菌株）尿细菌数>10⁵cfu/ml。多见于老年女性和妊娠期妇女，发病率随年龄增长而增加。患者无尿频、尿急、尿痛，无肉眼可见血尿，无腰痛、寒战或发热等尿路感染症状（D错）且尿细菌计数2.13×10⁵cfu/ml>10⁵cfu/ml，符合无症状菌尿临床表现。患者无腰痛、寒战或发热排除肾盂肾炎（BE错）。患者无尿频、尿急、尿痛排除膀胱炎（A错）。